枳术丸的功用是
A. 行气化滞
B. 消食导滞
C. 消痞除癓
D. 燥湿和胃
E. 健脾消痞

正确答案：E。健脾消痞

解析：枳术丸方证由脾虚气滞，饮食停聚所致。治以健脾消痞（E对）。